冷冻饮品与饮料的原料用水硬度（以碳酸度计）应低于
A. 15°
B. 10°
C. 8°
D. 5°
E. 2°

正确答案：C。8°

解析：本题考查冷冻饮品与饮料的原料用水硬度（以碳酸度计）。冷冻饮品与饮料的原料用水硬度（以碳酸度计）应低于8°（C对ABDE错）。